按土壤镉的环境质量标准（Ⅱ类）为0.3mg/kg计，某地区土壤镉环境本底值为0.2mg/kg，则该地区土壤镉的环境容量为
A. 0.1mg/kg
B. 0.2mg/kg
C. 0.3mg/kg
D. 0.4mg/kg
E. 0.5mg/kg

正确答案：A。0.1mg/kg

解析：本题考查环境容量。环境容量指的是环境能够承受的最大污染物负荷值，是环境质量标准和环境本底值的差值。因此，本题该地区土壤镉的环境容量为：0.3mg/kg－0.2mg/kg＝0.1mg/kg（A对BCDE错）。